呆小症与侏儒症的最大区别是
A. 身体更矮
B. 内脏增大
C. 智力低下
D. 肌肉发育不良
E. 身体不成比例

正确答案：C。智力低下